依据《中华人民共和国药品管理法实施条例》的规定，审查批准药物临床试验、生产药品和进口药品的部门是
A. 所在地县（市）级药品监督管理机构
B. 所在地省级药品监督管理部门
C. 国务院药品监督管理部门
D. 所在地省级卫生行政部门
E. 所在地县级卫生行政部门

正确答案：C。国务院药品监督管理部门